3-位有羟基的甾体激素是
A. 黄体酮
B. 甲睾酮
C. 雌二醇
D. 苯丙酸诺龙
E. 醋酸甲地孕酮

正确答案：C。雌二醇

解析：本题考查甾体激素类药物。雌二醇（C对）3位带有酚羟基。黄体酮（A错）、醋酸甲地孕酮（E错）、甲睾酮（B错）、苯丙酸诺龙（D错）3位均为羰基。